关于减少瘢痕形成的重要措施，不正确的是哪一项
A. 平行与皮肤的天然皱纹设计切口
B. 电刀手术创伤大，切口不齐
C. 术后无感染
D. 用细针细线正确对位缝合
E. 适当早期（面部无张力5天，颈部无张力7天）拆线

正确答案：B。电刀手术创伤大，切口不齐

解析：本题考查减少瘢痕形成的措施。电刀切割形成的创缘不齐，对皮肤组织损伤较大，创伤大（B错，为本题的正确答案），不能减少瘢痕的形成。平行与皮肤的天然皱纹设计切口（A对）能减少切断皮肤弹力纤维，从而减少瘢痕的形成。细针细线正确缝合（D对）、适当早期拆线（E对）以及术后无感染（C对）也都是能减少瘢痕形成的重要措施。